联合用药对使异烟肼失去抗菌作用的中成药是
A. 防风通圣丸（麻黄碱）
B. 蛇胆川贝液（苦杏仁苷）
C. 丹参片（丹参酮）
D. 昆布片（碘）
E. 六神丸（蟾蜍）

正确答案：D。昆布片（碘）

解析：本题考查联合用药。昆布片（D对）中含碘，在胃酸条件下与异烟肼发生氧化反应，形成异烟酸、卤化物和氮气，使异烟肼失去抗结核分枝杆菌的功效。